用聚酰氨分离黄酮类洗脱剂选择水-乙醇系统时，最后被洗脱下来的化合物是
A. 5，7-二羟基黄酮
B. 5，7，4’-三甲氧基黄酮
C. 5，7，3'，4’-四甲氧基黄酮
D. 3，5，7，3’，4’-五甲氧基黄酮
E. 3，5，7，3’，4’，5’-六羟基黄酮

正确答案：E。3，5，7，3’，4’，5’-六羟基黄酮

解析：本题考查的是黄酮类化合物的提取分离。用聚酰胺分离黄酮类洗脱剂选择水-乙醇系统时，最后被洗脱下来的化合物是3，5，7，3’，4’，5’-六羟基黄酮（E对）。聚酰胺是分离黄酮类化合物的吸附剂。吸附强度主要根据黄酮类化合物分子中羟基的数目与位置及溶剂与黄酮类化合物或与聚酰胺之间形成氢键缔合能力的大小。母核上含羟基越多，被洗脱下来越慢。